膜迷路不出现
A. 椭圆囊
B. 球囊
C. 耳蜗
D. 膜半规管
E. 蜗管

正确答案：C。耳蜗

解析：膜迷路由椭圆囊（A对）和球囊（B对）、膜半规管（D对）和蜗管（E对,故C为本题正确答案）3 部分组成。